关于下颌下三角的境界，叙述正确的是
A. 界于胸锁乳突肌、二腹肌后腹及肩胛舌骨肌上腹之间
B. 界于两侧二腹肌前腹与舌骨之间
C. 界于胸锁乳突肌、肩胛舌骨肌上腹及颈前正中线之间
D. 界于二腹肌前、后腹与下颌骨下缘之间
E. 界于两侧胸锁乳突肌及下颌骨下缘之间

正确答案：D。界于二腹肌前、后腹与下颌骨下缘之间

解析：下颌下三角的境界：上界为下颌骨下缘，下界为二腹肌的前、后腹。其底由下颌舌骨肌、舌骨舌肌和咽上缩肌等构成。掌握“颈部分区、颈筋膜层次及下颌下三角解剖特点”知识点。